液体石蜡属于
A. 极性溶剂
B. 非极性溶剂
C. 半极性溶剂
D. 着色剂
E. 防腐剂

正确答案：B。非极性溶剂

解析：本题考查液体制剂的溶剂。液状石蜡属于非极性溶剂（B对AC错）；着色剂（D错）为食品着色的物质，包括天然色素和合成色素；防腐剂（E错）是能抑制微生物活动,防止食品腐败变质的一类食品添加剂。